下列哪项不属于影响创伤愈合的全身因素
A. 营养不良
B. 伤口感染
C. 免疫功能低下
D. 全身并发症
E. 大量使用细胞增生抑制剂

正确答案：B。伤口感染